患者，男26岁，胸部外伤后致右侧血胸10天。曾行胸腔穿刺治疗，今日出现寒战、高热胸痛。X线胸片示：右胸内积液较前增加，下述哪种治疗恰当
A. 反复胸腔穿刺
B. 开胸手术清除脓液
C. 胸腔闭式引流
D. 每日胸内注入抗生素
E. 胸腔闭合引流负压吸引

正确答案：C。胸腔闭式引流

解析：根据题干提供的患者的病史及影像学表现提示该患者为外伤性血胸后的急性脓胸，最恰当的治疗应为胸腔闭式引流，彻底排净脓液，使肺早日复张，同时根据致病菌对于药物的敏感性，选用有效的抗生素。掌握“血胸”知识点。